发病率通常不用来表示
A. 病程短的急性病的调查
B. 各种疾病的暴发调查
C. 各种疾病流行时的调查
D. 病程较长的慢性病的调查
E. 突发卫生事件时的疾病调查

正确答案：D。病程较长的慢性病的调查